常用的菌斑染色剂是
A. 龙胆紫
B. 碘酊
C. 中性红
D. 四碘荧光素钠
E. C+D

正确答案：E。C+D

解析：本题考查常用的菌斑染色剂。菌斑染色剂能使肉眼不易辨别的菌斑染色而显现，以了解牙面的不洁状态，检查评价菌斑控制程度，才能彻底地去除菌斑以及准确评价菌斑控制的效果。常用的菌斑显色剂有2%的碱性品红、中性红（C对）、2%～5%藻红、酒时黄、1.0%～2.5%孔雀绿、四碘荧光素钠（D对）。（CD均对，E为本题的正确答案）。龙胆紫（A错）是口腔修复科常用的义齿基托组织面缓冲指示剂。碘酊（B错）是皮肤或口腔黏膜的消毒剂。